目前造成世界上致死率最高的病毒性出血热的病毒是
A. 埃博拉病毒
B. 克里米亚-刚果出血热病毒
C. 汉坦病毒
D. 登革病毒
E. 寨卡病毒

正确答案：A。埃博拉病毒